羌活商品药材按形态分为
A. 根羌
B. 竹节羌
C. 大头羌
D. 条羌
E. 蚕羌

正确答案：B、C、D、E。竹节羌；大头羌；条羌；蚕羌